诊断为流行性出血热患者，在病程第六天，尿量仅80ml，血压186/98mmHg，脉洪大，面水肿，体表静脉充盈，两肺底有散在湿罗音，对此病在治疗上应立即采用下列哪组措施治疗为好
A. 严格控制输液量、应用高效利尿剂、导泻
B. 采用高渗葡萄糖液，降压，利尿
C. 采用平衡盐液，降压，利尿，导泻
D. 采用利尿合剂、扩血管药，纠正酸中毒
E. 纠正酸中毒，降压，应用激素，利尿

正确答案：A。严格控制输液量、应用高效利尿剂、导泻